原植物属于五加科的药材是
A. 木通
B. 川木通
C. 通草
D. 钩藤
E. 降香

正确答案：C。通草

解析：本题考查的是通草的来源。原植物属于五加科的药材是通草（C对）。通草：【来源】为五加科植物通脱木的干燥茎髓。木通（A错）：【来源】为木通科植物木通、三叶木通或白木通的干燥藤茎。川木通（B错）：【来源】为毛茛科植物小木通或绣球藤的干燥藤茎。钩藤（D错）：【来源】为茜草科植物钩藤、大叶钩藤、毛钩藤、华钩藤或无柄果钩藤的干燥带钩茎枝。降香（E错）：【来源】为豆科植物降香檀的树干和根的干燥心材。